额鼻突末端被两个凹陷分成三个突起在
A. 胚胎第3周
B. 胚胎第4周
C. 胚胎第5周
D. 胚胎第6周
E. 胚胎第8周

正确答案：B。胚胎第4周

解析：胚胎第4周末，额鼻突的末端被两个凹陷分成三个突起，中间的成为中鼻突，两侧的称为侧鼻突。上述两个凹陷为鼻的始基，称嗅窝。掌握“面部的发育”知识点。